具有利湿退黄，解毒疗疮功效的药物是
A. 泽泻
B. 滑石
C. 茵陈
D. 萆薢
E. 地肤子

正确答案：C。茵陈

解析：该题考查茵陈的功效。茵陈味苦、辛，性微寒，入脾、胃、肝、胆经，其功效为清利湿热，利胆退黄。茵陈苦微寒，有解毒疗疮之功（C对）。